男，68岁。近2年反复出现发作性心悸，伴头晕、黑朦、查体：BP135/65mmHg，心率52次/分，律齐，心脏各瓣膜听诊区未闻及杂音。动态心电图：窦性心律为主，平均心率56次/分；R-R长间歇35次，最长4.2秒伴房室交界逸博；房性期前收缩，短阵房性心动过速，一度房室传导阻滞。最能提示该患者为病态窦房结综合征诊断的动态心电图表现是
A. —度房室传导阻滞
B. R-R长间歇35次，最长4.2秒伴房室交界逸博
C. 窦性心律为主，平均心率56次/分
D. 房性期前收缩
E. 短阵房性心动过速

正确答案：B。R-R长间歇35次，最长4.2秒伴房室交界逸博

解析：患者老年男性，近2年反复出现发作性心悸，伴头晕、黑朦（病态窦房结综合征常见临床表现）。查体：BP135/65mmHg（正常值90～120/60～80mmHg，为正常高值血压），心率52次/分（正常值60～100次/分，为心动过缓），律齐，心脏各瓣膜听诊区未闻及杂音。动态心电图：R-R长间歇35次，最长4.2秒伴房室交界逸博，提示窦性心动过缓及窦性停搏，窦性心率为35次/分，在50次/分以下（B对）。窦性心律为主，平均心率56次/分（C错）、房性期前收缩（D错）、短阵房性心动过速（E错）、一度房室传导阻滞（A错）均不是提示病态窦房结综合征诊断的动态心电图主要表现。